关于蓄积系数说法正确的是
A. K＝LD₅₀（1）/LD₅₀（n）
B. K﹤5为轻度蓄积
C. K﹥3为中度蓄积
D. K﹥1为明显蓄积
E. K﹤1为高度蓄积

正确答案：E。K﹤1为高度蓄积